卵巢恶性生殖细胞肿瘤常用化疗方案为
A. 顺铂+紫杉醇
B. 紫杉醇+卡铂
C. 顺铂+长春新碱+异环磷酰胺
D. 顺铂+长春新碱
E. 博来霉素+长春新碱

正确答案：C。顺铂+长春新碱+异环磷酰胺

解析：卵巢恶性生殖细胞肿瘤有BEP方案和EP方案。BEP方案包括依托泊苷，顺铂，博来霉素。EP方案包括依托泊苷，顺铂。若BEP方案无效，则采用VIP方案，即顺铂+长春新碱+异环磷酰胺（C对）。